下列哪种激素属于含氮类激素
A. 1，25二羟维生素D₃
B. 雌二醇
C. 睾酮
D. 醛固酮
E. 促甲状腺激素

正确答案：E。促甲状腺激素